既能活血，又能利尿的药有
A. 茜草
B. 瞿麦
C. 益母草
D. 王不留行
E. 海金沙

正确答案：C、D。益母草；王不留行

解析：本题考查的是益母草与王不留行的功效。既能活血，又能利尿的药有益母草（C对）与王不留行（D对）。益母草：【功效】活血祛瘀，利尿消肿，清热解毒。王不留行：【功效】活血通经，下乳消肿，利尿通淋。茜草（A错）：【功效】凉血，祛瘀，止血，通经。瞿麦（B错）：【功效】利尿通淋，破血通经。海金沙（E错）：【功效】利尿通淋，止痛。